营养胃的动脉来源于
A. 肝门静脉
B. 肠干
C. 肠系膜上动脉
D. 腹腔干
E. 下腔静脉

正确答案：D。腹腔干

解析：腹腔干（D对）为营养胃的动脉来源。其分支胃左动脉沿途分支至食管的腹段、贲门和胃小弯附近的胃壁。肝总动脉发出分支肝固有动脉，其分支分布于胃小弯侧的胃壁，胃十二指肠动脉的分支分布于胃大弯右侧的胃壁和大网膜。脾动脉发出胃短动脉和胃后动脉至胃底，发出胃网膜左动脉分布于胃大弯左侧的胃壁和胃网膜。